某食堂6月份供应蛋炒饭，引起近百人食物中毒。发病潜伏期约8小时，以腹痛、腹泻为主要症状，不发热，病程为16~36小时，预后良好。经卫生学调查发现，蛋炒饭所用的米饭是前一天的剩饭。初步诊断为
A. 肉毒梭菌毒素食物中毒
B. 蜡样芽孢杆菌食物中毒
C. 金黄色葡萄球菌中毒
D. 致病性大肠埃希菌食物中毒
E. 变形杆菌食物中毒

正确答案：B。蜡样芽孢杆菌食物中毒